构成医疗事故的主观方面，应当是
A. 技术水平欠缺的技术过失
B. 违反卫生法规和诊疗护理规范，常规的责任过失
C. 故意违反操作规程
D. 疏忽大意的过失
E. 过于自信的过失

正确答案：B。违反卫生法规和诊疗护理规范，常规的责任过失

解析：医疗事故是指医疗机构及其医务人员在医疗活动中，违反医疗卫生管理法律、行政法规、部门规章和诊疗护理规范、常规，过失造成患者人身损害的事故。其主观方面应当是违反卫生法规和诊疗护理规范、常规的责任的过失（B对）。技术水平欠缺的技术过失（A错）属于医疗事故的客观方面。医疗事故的构成要件包括其直接行为人在诊疗护理中存在主观过失；过失是指在法律上指应注意、能注意而不注意造成了危害。患者的损伤是由医疗机构和医护人员的故意违反操作规程（C错）造成的，不属于医疗事故。疏忽大意的过失（D错）和过于自信的过失（E错）是《刑法》将犯罪过失根据行为人是否已经预见危害结果而分的两类。